《中华人民共和国药品管理法》规定，制定药物临床试验机构资格认定办法的部门是
A. 国务院药品监督管理部门
B. 国务院卫生行政部门
C. 国务院科技管理部门
D. 国务院经济综合主管部门
E. 国务院药品监督管理部门、国务院卫生行政部门

正确答案：E。国务院药品监督管理部门、国务院卫生行政部门

解析：本题考查药品研制和注册。《中华人民共和国药品管理法》规定，制定药物临床试验机构资格认定办法的部门是国务院药品监督管理部门、国务院卫生行政部门（E对）。《中华人民共和国药品管理法》第二章药品研制和注册第十九条：开展药物临床试验，应当按照国务院药品监督管理部门（A错）的规定如实报送研制方法、质量指标、药理及毒理试验结果等有关数据、资料和样品，经国务院药品监督管理部门批准。国务院药品监督管理部门应当自受理临床试验申请之日起六十个工作日内决定是否同意并通知临床试验申办者，逾期未通知的，视为同意。其中，开展生物等效性试验的，报国务院药品监督管理部门备案。开展药物临床试验，应当在具备相应条件的临床试验机构进行。药物临床试验机构实行备案管理，具体办法由国务院药品监督管理部门、国务院卫生健康主管部门共同制定。